壮热，面赤，汗多，心烦，渴喜凉饮，舌质红，苔黄燥，脉洪大有力方选
A. 神犀丹
B. 安宫牛黄丸
C. 三甲复脉汤
D. 白虎汤
E. 羚角钩藤汤

正确答案：D。白虎汤

解析：“壮热，面赤，汗多，心烦，渴喜凉饮，舌质红，苔黄燥，脉洪大有力”乃阳明邪热内盛的证候。正邪剧争，阳明胃热亢盛，里热蒸腾，则壮热，恶热，苔黄燥，脉洪大有力；里热迫津外泄，故汗多；邪热炽盛上炎，故面赤；热盛伤津，引水自救，故渴喜凉饮。治宜清热保津，方选白虎汤（D对）。方中生石膏辛寒，入肺胃二经，清泄胃热，达热出表；知母苦寒而性润，清热养阴，与石膏配伍，可增强清热止渴除烦之力；生甘草泻火解毒，调和诸药，配粳米可保养胃气，祛邪而不伤正，配石膏则可甘寒生津。